与桂枝配伍能调和营卫的药物是
A. 白芍
B. 甘草
C. 大枣
D. 赤芍
E. 干姜

正确答案：A。白芍

解析：桂枝性味辛温，助卫阳，通经络，解肌发表而祛在表之风寒，白芍酸甘而凉，益阴敛营，敛固外泄之营阴，两药相配可营卫同治，邪正兼顾（A对）。